下述哪块腕骨具有鞍状关节面
A. 舟骨
B. 月骨
C. 大多角骨
D. 头状骨
E. 小多角骨

正确答案：C。大多角骨

解析：第 1 掌骨短而粗，其底有鞍状关节面，与大多角骨的鞍状关节面相关节（C对）。